在可摘局部义齿就位方式的选择中，使缺隙两端基牙的倒凹适当地集中在一端基牙，应采用的方法是
A. 调凹法
B. 均凹法
C. 填凹法
D. 减凹法
E. 增凹法

正确答案：A。调凹法

解析：调节倒凹（调凹法）：调凹就是使缺隙两端基牙的倒凹适当地集中在一端基牙，产生有利的倒凹。掌握“局部义齿类型，肯氏分类及模型观测”知识点。